在大脑半球上外侧面看不到的沟，回是
A. 中央沟
B. 额下沟
C. 顶内（间）沟
D. 颞上沟
E. 顶枕沟

正确答案：E。顶枕沟

解析：顶枕沟（E对）位于大脑半球内侧面的后部，在大脑半球外侧看不到。